在植物器官中，只有种子含有
A. 脂肪油
B. 挥发油
C. 淀粉粒
D. 菊糖
E. 糊粉粒

正确答案：E。糊粉粒